下列哪种疾病伴有右心室前负荷明显加重？
A. 肺源性心脏病
B. 肺动脉瓣狭窄
C. 高血压病
D. 室间隔缺损
E. 心肌病

正确答案：D。室间隔缺损

解析：室间隔缺损（D对）出现左向右分流时，左心室的血液反流入右心室，导致右心室前负荷明显加重。COPD引起肺循环阻力增加，使右心室后负荷过重，久之导致肺源性心脏病（A错）。肺动脉瓣狭窄（B错）时，肺循环阻力增加，导致右心室后负荷加重。高血压病（C错）时，体循环阻力增加，导致左心室后负荷加重。心肌病（E错）时，可有心肌细胞变性坏死（扩张性心肌病）导致心肌收缩性降低或心肌顺应性减退（限制性心肌病）导致心室舒张及充盈受限。